下列属于宫体癌综合征的高危因素是
A. 肥胖
B. 高血压
C. 未婚
D. 少产的妇女
E. 以上均是

正确答案：E。以上均是

解析：本题考查宫体癌综合征的高危因素。内膜癌易发生于肥胖、高血压、糖尿病、未婚、少产的妇女（E对ABCD错），这些因素是子宫内膜癌常见的高危因素，称为宫体癌综合征。